鉴定油脂酸败最早期的指标是
A. 挥发性盐基总氮
B. 过氧化值
C. pH
D. 组胺
E. 三甲胺

正确答案：B。过氧化值

解析：本题考查鉴定油脂酸败最早期的指标。过氧化值（B对ACDE错）是鉴定油脂酸败最早期的指标。